在印度丛林有两个狼抚养的孩子，他们与狼共同7年，发现之后，将其带回家，10年后，他们还是不会人类的语言，只能一些简单的表达，但是他们还是能够听懂狼的语言，这事件说明
A. 人类的自制力存在关键期
B. 儿童时期对人的发展很重要
C. 人的语言与智力发展存在关键期
D. 人格发展存在关键期
E. 人接受一种语言后很难改

正确答案：C。人的语言与智力发展存在关键期

解析：根据旧版教材，人的智力发展的关键期在7岁前，题中与狼从小生活到7岁的孩子，10年后依然学不会人类的语言，说明人的语言与智力发展存在关键期（C对），关键期比其他任何时期都更容易习得语言，过了这段时期以后，一般很难习得完美的母语。题中并没有涉及自制力（A错）和人格（D错）发展，只涉及语言能力，也并没有涉及儿童期对人发展的意义（B错）。人在成长过程中还可以接受其他语言（E错），但是掌握程度不如7岁前习得的母语。